一岁以内婴儿总能量约需每日每公斤体重
A. 80kcal
B. 90kcal
C. 100kcal
D. 110kcal
E. 120kcal

正确答案：A。80kcal

解析：九版儿科学<6月龄婴儿能量平均需要量为90kcal(376.56kJ）/(kg·d），7～12月龄为80kcal(334.72kJ）/(kg·d）。